根据《处方药与非处方药分类管理办法（试行）》，关于药品按处方药与非处方药分类管理的说法，正确的是
A. 按照药品品种、规格、给药途径及疗效的不同进行分类
B. 按照药品类别、规格、适应症、成本效益比的不问进行分类
C. 按照药物经济学评价指标中的风险效益比成成本效益比的不同进行分类
D. 按照药品品种、包装规格、适应症、剂量及给药途径的不同进行分类
E. 按照药品品种、规格、适应症、剂量及给药途径的不同进行分类

正确答案：E。按照药品品种、规格、适应症、剂量及给药途径的不同进行分类

解析：本题考查处方药与非处方药分类。根据《处方药与非处方药分类管理办法（试行）》，关于药品按处方药与非处方药分类管理的说法，正确的是按照药品品种、规格、适应症、剂量及给药途径的不同进行分类（E对）。《处方药与非处方药分类管理办法（试行）》第二条：根据药品品种、规格、适应症、剂量及给药途径不同，对药品分别按处方药与非处方药进行管理。处方药必须凭执业医师或执业助理医师处方才可调配、购买和使用；非处方药不需要凭执业医师或执业助理医师处方即可自行判断、购买和使用。